犬吠样咳嗽可见于
A. 急性喉炎
B. 急性支气管炎
C. 支气管哮喘
D. 肺结核
E. 肺癌

正确答案：A。急性喉炎

解析：咳嗽的音色对疾病的诊断有一定提示意义，犬吠样咳嗽可见于急性喉炎（A对）或气管受压等。急性支气管炎（B错）、支气管哮喘（C错）、肺结核（D错）咳嗽音色多无特异性。肺癌（E错）可见金属音咳嗽。